我国主产三七的省（区）有
A. 江苏
B. 宁夏
C. 广西
D. 云南
E. 海南

正确答案：C、D。广西；云南

解析：本题考查的是三七的产地。我国主产三七的省（区）有云南（C对）与广西（D对）。三七：【产地】主产于云南文山，广西田阳、靖西、百色等地。主产于江苏（A错）的药材有虎杖、太子参、威灵仙、苍术、三棱、木通、侧柏叶、紫苏叶、洋金花、地肤子、菟丝子、紫花地丁、荆芥、薄荷、土鳖虫、僵蚕、等。主产于宁夏（B错）的药材有银柴胡、枸杞子等。主产于海南（E错）的药材有槟榔、益智等。